增加左旋多巴疗效，减少不良反应的药物是
A. 卡比多巴
B. 维生素B₆
C. 利血平
D. 苯海索
E. 苯乙肼

正确答案：A。卡比多巴